女性青春期开始的重要标志是
A. 月经来潮
B. 内生殖器官发育渐趋成熟
C. 外生殖器官发育渐趋成熟
D. 体形已渐发育为女性特有的体形
E. 第二性征发育

正确答案：A。月经来潮

解析：女性第一次月经来潮称月经初潮，是青春期的重要标志（A对）。青春期内外生殖器官发育渐趋成熟（BC错），第二性征发育（E错），呈现女性特有体态（D错）。